含芳香挥发性成分的中药饮片，干燥温度不宜超过
A. 90℃
B. 80℃
C. 70℃
D. 60℃
E. 50℃

正确答案：E。50℃

解析：本题考查饮片干燥的方法。含芳香挥发性成分的中药饮片，干燥温度不宜超过50℃（E对）。人工干燥的温度，应视药物性质而灵活掌握。一般药物以不超过80℃（B错）为宜。含芳香挥发性成分的饮片以不超过50℃为宜。已干燥的饮片需晾凉后再贮存，否则，余热会使饮片回潮，易于发生霉变。干燥后的饮片含水量应控制在7%～13%为宜。